以下属于以黏液性腺泡为主的混合性小涎腺的是
A. 腮腺
B. 下颌下腺
C. 舌下腺
D. 唇腺
E. 腭腺

正确答案：D。唇腺

解析：本题考查唾液腺的病理表现。属于以黏液性腺泡为主的混合性小涎腺的是唇腺（D对）。唇腺、颊腺、磨牙后腺均属混合性腺体，但以黏液性腺泡为主。腮腺（A错）全部由浆液性腺泡组成，故属纯浆液腺。下颌下腺（B错）是混合腺，以浆液性腺泡为主，并有少数黏液性腺泡和混合性腺泡。舌下腺（C错）是一种混合腺，其中黏液性腺泡占主要部分。腭腺（E错）属于纯黏液腺。